“安身之本，必资于食”的养生理论出自
A. 老子
B. 达摩
C. 庄子
D. 孙思邈
E. 孔子

正确答案：D。孙思邈

解析：“安身之本，必资于食”的养生理论出自孙思邈的《备急千金要方·食治·序论》，人的生命靠五味滋养，健康也会因五味损伤，所以说安身之本在于饮食，如果不知道饮食宜忌就不足以保存生命（D对）。老子的养生之道：以"慈"养生、以“俭”养生、以“不敢为天下先”养生（A错）。达摩的指导思想是“内养浩然之灵气，外练筋骨之刚柔”（B错）。庄子的养生之道是：少私、寡欲、清净、豁达（C错）。孔子的养生之道有谨慎用药、饮食讲究、依礼而行（E错）。